粘固剂厚度一般不得超过
A. 10μm
B. 20μm
C. 30μm
D. 40μm
E. 50μm

正确答案：C。30μm

解析：粘固剂厚度：其最大被膜厚度一般不得超过30μm。粘固剂被膜厚度增加不仅降低粘固强度，而且会使修复体粘固后咬合抬高。掌握“修复体试戴、磨光与粘固”知识点。